男性，45岁。36小时前施工时右下肢被石板砸伤，X光摄片，未见骨折，行清创缝合。现突然出现烦躁不安，伴恐惧感，大汗淋漓，自述右下肢伤处疼痛加重，胀裂感。体温38.5℃，脉搏128次/分，血压146/92mmHg，右小腿肿胀明显，大量浆液血性渗出物自切口渗出，皮肤表面呈大理石样花纹，渗出物呈恶臭味。出现本病的可能原因为
A. 清创不彻底
B. 病人有复合创伤
C. 未注射TAT
D. 病人低蛋白血症
E. 切口包扎过紧

正确答案：A。清创不彻底

解析：患者右下肢被砸伤，砸伤后伤处疼痛，肿胀明显有胀裂感，大量浆液血性渗出物自切口渗出，皮肤表面呈大理石样花纹（皮肤表面呈大理石样花纹是气性坏疽的特征性表现之一），渗出物呈恶臭味（提示受伤处组织出现液化和腐败可能），可诊断为气性坏疽。气性坏疽的致病菌是厌氧菌，包扎过紧可造成伤口内无氧环境，增加发生气性坏疽的几率，但若清创彻底，即使是厌氧环境，气性坏疽的发生率仍较低，故切口包扎过紧（E错）并非该患者出现气性坏疽的主要致病原因。该患者行清创缝合后出现气性坏疽，表明伤口还存在致病菌，致病主要原因应为清创不彻底（A对），而病人有复合伤（B错）及低蛋白血症（D错）均不是导致气性坏疽的原因。未注射TAT（C错）可能引起破伤风，而非气性坏疽。